对以下打喷嚏、流鼻涕为主的患者，有一定镇静作用
A. 右美沙芬
B. 奥司他韦
C. 金刚乙胺
D. 氯苯那敏
E. 伪麻黄碱

正确答案：D。氯苯那敏

解析：本题考查氯苯那敏。对以下打喷嚏、流鼻涕为主的患者，有一定镇静作用的是氯苯那敏（D对）。打喷嚏、流鼻涕为过敏性鼻炎的典型的表现，故可选用含氯苯那敏和苯海拉明等制剂。右美沙芬（A错）为中枢性镇咳药。奥司他韦（B错）、金刚乙胺（C错）为抗病毒药。伪麻黄碱（E错）为减鼻充血药。